可摘局部义齿按义齿的支持组织不同，可分为
A. 两种类型
B. 三种类型
C. 四种类型
D. 五种类型
E. 仅有一种类型

正确答案：B。三种类型

解析：本题考查可摘局部义齿的支持方式。可摘局部义齿按义齿的支持组织不同，可分为以下三种类型（B对）：牙支持式义齿、牙与黏膜混合支持式义齿、黏膜支持式义齿。